吸氧疗法对改善下列哪种疾病引起的缺氧效果最佳
A. 严重缺铁性贫血
B. 先天性心脏病右→左分流
C. 肺间质纤维化
D. 氰化物中毒
E. 亚硝酸盐中毒

正确答案：C。肺间质纤维化

解析：吸氧疗法对由先天性心脏病右向左分流（B错）所致缺氧的作用较小。严重缺铁性贫血（A错）和亚硝酸盐中毒（E错）的患者动脉血氧分压和氧饱和度均正常，此时氧疗的作用主要是通过提高动脉血氧分压、增加血液中物理溶解的氧量，氧向组织、细胞的弥散速度也会加快，改善组织供氧。氰化物中毒（D错）的患者供氧是正常的，此时的主要问题是细胞对氧的利用障碍，氧疗的效果不及其他类型的缺氧。而对于由肺间质纤维化（C对）引起的低张性缺氧来说，吸氧疗法是非常有效的。